强心苷治疗心功能不全的主要药理作用是
A. 降低心肌耗氧量
B. 正性肌力作用
C. 使已扩大的心室容积缩小
D. 减慢心率
E. 减慢房室传导

正确答案：B。正性肌力作用